不适合做可摘局部义齿修复的疾病是
A. 颞下颌关节病
B. 牙周病
C. AIDS
D. 癫痫
E. 偏头痛

正确答案：D。癫痫

解析：可摘局部义齿的禁忌证：①因意识或精神障碍，或行动障碍而生活不能自理的患者，不能摘戴、保管和清洁义齿，或有误吞义齿危险的患者。②有严重的牙体、牙周疾病而未得到完善的治疗和有效控制的患者。③有口腔黏膜病变或其他软硬组织病变，未治愈或未得到有效控制的患者。④缺牙间隙过窄，（牙合）龈距过小，可导致义齿强度不足者。⑤对义齿材料过敏或对义齿的异物感无法克服的患者。掌握“局部义齿类型，肯氏分类及模型观测”知识点。